与人争吵后突然倒地，首先判断
A. 意识
B. 呼吸
C. 桡动脉搏动
D. 血压
E. 股动脉搏动

正确答案：A。意识

解析：该患者与人争吵后突然倒地，首先要进行识别心脏骤停，判断患者的意识（A对）是该步骤首要进行的处理，接下来检查是否存在呼吸或停止呼吸（B错），同时判断动脉有无搏动（桡动脉搏动、股动脉搏动，CE错），血压测量（D错）不属于识别心脏骤停的步骤。